久病咳喘，乏力少气，呼多吸少，自汗耳鸣，舌淡脉弱，其证候是
A. 肺肾气虚
B. 肺气虚
C. 脾肺气虚
D. 心肺气虚
E. 肾气不固

正确答案：A。肺肾气虚

解析：咳喘，乏力少气，自汗可知有肺气虚的症状，呼多吸少为肾气虚，摄纳失常，气不归原的症状，耳鸣为肾气虚，耳窍不充的症状，故辨为肺肾气虚证（A对）。肺气虚无呼多吸少，耳鸣的症状（B错）。脾肺气虚有食少、腹胀、便溏等脾虚的症状（C错）。心肺气虚有胸闷、心悸的症状（D错）。肾气不固无咳喘、自汗等肺气虚的症状（E错）。